牙龈鲜红、光亮及上皮表层剥脱，形成粗糙的糜烂面，为以上哪项
A. 牙周萎缩
B. 牙周炎
C. 龈增生
D. 慢性龈炎
E. 剥脱性龈病损

正确答案：E。剥脱性龈病损

解析：本题考查牙龈疾病。牙龈鲜红、光亮及上皮表层剥脱，形成粗糙的糜烂面，为剥脱性龈病损（E对）。剥脱性龈病损是局限于牙龈的发红及脱屑样病变。临床特征是牙龈鲜红、光亮及上皮表层剥脱，形成粗糙的糜烂面；或上皮分离后未脱落，形成灰色徦膜。